男，18岁。自觉胸闷、气促10天，活动后加重。查体：左侧呼吸音明显减弱。胸部X线片示左侧气胸，左肺压缩40%，肋膈角可见小液平面。既往无类似病史。首选处理方法是
A. 吸氧观察
B. 胸腔闭式引流
C. 胸腔穿刺抽气
D. 胸腔镜探查
E. 开胸探查

正确答案：B。胸腔闭式引流

解析：青少年男性患者，胸部X线片示左侧气胸，左肺压缩40%（＞20%），故该患者首选处理方法是胸腔闭式引流（B对）。胸腔闭式引流主要用于不稳定型气胸，呼吸困难明显、肺压缩程度较重（通常＞20%），交通性或张力性气胸，反复发生气胸的患者。吸氧观察（A错）适用于稳定型小量气胸或首次发生的症状较轻的闭合性气胸，高浓度吸氧可加快胸腔内气体的吸收。胸腔穿刺抽气（C错）用于张力性气胸治疗。胸腔镜检查（D错）主要用于胸腔病变的诊断。开胸探查（E错）主要用于进行性血胸、心脏大血管损伤等严重胸部损伤的治疗。